普通感冒患者，有单纯性咳嗽症状，宜选用的药物是
A. 对乙酰氨基酚滴剂
B. 右美沙芬片
C. 氯苯那敏片
D. 茶碱缓释片
E. 氟替卡松干粉吸入剂

正确答案：B。右美沙芬片

解析：本题考查药物的适应证。右美沙芬片（B对）用于感冒、咽喉炎以及其它上呼吸道感染时的干咳。普通感冒患者，有单纯性咳嗽症状宜选用右美沙芬。普通儿童感冒患者，体温升高（＞38.5℃）时宜选用对乙酰氨基酚滴剂（A错）。对乙酰氨基酚为解热镇痛抗炎药，主要用于中、重度发热；为缓解轻中度骨性关节炎疼痛的首选药。普通感冒患者，有打喷嚏、流鼻涕的症状，宜选用氯苯那敏片（C错）。氯苯那敏属于抗组胺药，可以使下呼吸道的分泌物干燥和变稠，减少打喷嚏和鼻溢液，同时具有轻微的镇静作用。茶碱缓释片（D错）属于磷酸二脂酶抑制剂类的平喘药，用于缓解成人和3岁以上儿童的支气管哮喘的发作，哮喘急性发作后的维持治疗，也用于缓解阻塞性肺疾病伴有的支气管痉挛症状。氟替卡松干粉吸入剂（E错）为吸入性糖皮质激素，用于持续性哮喘的长期治疗，季节性过敏性鼻炎（包括枯草热）和常年性过敏性鼻炎的预防和治疗。